流行病学的实际应用范围不包括
A. 了解疾病的自然史
B. 疾病病因和危险因素研究
C. 疾病预防和健康促进
D. 疾病的监测
E. 疾病的临床症状和体征

正确答案：E。疾病的临床症状和体征

解析：本题考查流行病学的应用。流行病学的应用包括：①疾病预防和健康促进（C对）；②疾病监测（D对）；③疾病病因和危险因素研究（B对）；④疾病的自然史（A对）；⑤疾病防治的效果评价。疾病的临床症状和体征（E错，为本题正确答案）不属于流行病学的应用范围。